根据《中华人民共和国药品管理法实施条例》，私人诊所可以配备的药品有
A. 限制使用级抗菌药物
B. 常用药品
C. 急救药品
D. 诊断药品
E. 血液制品

正确答案：B、C。常用药品；急救药品

解析：本题考查药品管理。根据《中华人民共和国药品管理法实施条例》，个人设置的门诊部、诊所等医疗机构不得配备常用药品（B对）和急救药品（C对）以外的其他药品。